诊断宫内早孕最可靠的辅助检查方法是
A. 尿妊娠试验
B. 基础体温测定
C. B型超声检查
D. 阴道脱落细胞学检查
E. 宫颈黏液涂片干燥后镜检

正确答案：C。B型超声检查